下列阳明腑实证的临床表现应除外哪项
A. 脉沉迟而实
B. 日晡潮热
C. 腹胀拒按
D. 大便秘结
E. 身热不扬

正确答案：E。身热不扬

解析：身热不扬属于发热之一种，患者自身感觉发热，按其肌肤却不甚热的一种表现。可见身热稽留而热象不剧，或医生初扪病者体表不觉热甚，久则感到热盛灼手的表现，多见于湿温病，热为湿遏，以致发热在里，热势不扬（E错，为本题正确答案）。阳明腑实证里热蒸达，迫津外泄，故见高热，汗出口渴；大肠属于阳明经，其气旺于日晡之时，故见日晡潮热（B对）；热结肠道，气机壅滞，肠中燥屎内结，腑气不通，津液耗伤，肠道失润故腹部硬满疼痛拒按（C对），大便秘结（D对）；脉沉迟而实（A对）均为里热炽盛之象。